单端固定桥的固位力主要依靠
A. 重力
B. 摩擦力
C. 动力
D. 吸附力
E. 大气压力

正确答案：B。摩擦力

解析：除粘接固定桥主要靠粘结力固位外，其余固定桥固位力主要是靠约束力、摩擦力和粘结力。掌握“固定桥的组成和分类”知识点。